《中国药典》规定薄荷药材含叶量不得少于
A. 30%
B. 25%
C. 35%
D. 15%
E. 20%

正确答案：A。30%

解析：本题考查的是全草类中药含叶量的检査。《中国药典》规定薄荷药材叶不得少于30%（A对）。大多数药材其药效成分在植物体不同的部位（器官）中，含量是不均衡的。如全草类的穿心莲、薄荷、广藿香的主要有效成分主要存在于叶中或在叶中的含量远高于其他部位。这些药材在采收、加工、炮制、运输过程中，常因其叶在干燥后易脱落或碎裂而致其商品药材中所含叶量少而主要为茎秆，使得药材和饮片总体质量下降。《中国药典》规定穿心莲中药材叶不得少于30%，薄荷药材中叶不得少于30%，广藿香药材中叶不得少于20%（E错），从而保证这些中药的总体质量。